根据《药品广告审查办法》发布进口药品广告的审查程序是
A. 向所在省级工商管理部门办理备案
B. 向所在省级工商管理部部门申请并取得药品广告批准文号
C. 向所在省级药品监督管理部门申请并取得药品广告批准文号
D. 向所在省级药品监督管理部门办理备案

正确答案：C。向所在省级药品监督管理部门申请并取得药品广告批准文号

解析：本题考查药品价格和广告的管理。根据《药品广告审查办法》发布进口药品广告的审查程序是向所在省级药品监督管理部门申请并取得药品广告批准文号（C对）。《中华人民共和国药品管理法实施条例》第七章药品价格和广告的管理第四十八条：发布药品广告，应当向药品生产企业所在地省、自治区、直辖市人民政府药品监督管理部门报送有关材料。省、自治区、直辖市人民政府药品监督管理部门应当自收到有关材料之日起10个工作日内作出是否核发药品广告批准文号的决定；核发药品广告批准文号的，应当同时报国务院药品监督管理部门备案。具体办法由国务院药品监督管理部门制定。发布进口药品广告，应当依照前款规定向进口药品代理机构所在地省、自治区、直辖市人民政府药品监督管理部门申请药品广告批准文号。在药品生产企业所在地和进口药品代理机构所在地以外的省、自治区、直辖市发布药品广告的，发布广告的企业应当在发布前向发布地省、自治区、直辖市人民政府药品监督管理部门备案（D错）。接受备案的省、自治区、直辖市人民政府药品监督管理部门发现药品广告批准内容不符合药品广告管理规定的，应当交由原核发部门处理。